百合固金汤所治阴虚证的主要脏腑是
A. 肺、肾
B. 肝、胃
C. 心、肝
D. 脾、胃
E. 肺、胃

正确答案：A。肺、肾

解析：百合固金汤方证由肺肾阴亏所致。病位在肺、肾。肺乃肾之母，肺虚及肾，病久则肺肾阴虚，阴虚生内热，虚火上炎，肺失肃降，则咳嗽气喘（A对）。趣记：弟弟卖草药，百元节归母。（生地、熟地、麦冬、甘草、芍药、百合、玄参、桔梗、当归、贝母）。